具有化湿行气温中止呕功效的药物是
A. 厚朴
B. 苍术
C. 藿香
D. 佩兰
E. 白豆蔻

正确答案：E。白豆蔻

解析：白豆蔻性味辛温，归肺、脾、胃经，其功效为化湿行气，温中止呕，开胃消食（E对）。厚朴的功效为燥湿，行气，消积，消痰平喘（A错）。苍术的功效为燥湿健脾，祛风散寒，明目（B错）。藿香的功效为芳香化湿，和中止呕，发表解暑（C错）。佩兰的功效为芳香化湿，醒脾开胃，发表解暑（D错）。